表明暴露组的危险度与对照组的危险度之比的指标是
A. 人群归因危险度
B. 特异危险度
C. 归因危险度百分比
D. 相对危险度
E. 人群归因危险度百分比

正确答案：D。相对危险度